下列有关牙尖交错位的相关叙述中，不恰当的一项是
A. 是牙尖交错（牙合）时下颌骨的位置
B. 当牙尖交错（牙合）位于正中时也称正中（牙合）位
C. 上下牙的牙尖交错位是稳定的，不会改变
D. 牙尖交错位也称牙位
E. 牙尖交错位可重复

正确答案：C。上下牙的牙尖交错位是稳定的，不会改变

解析：牙尖交错（牙合）时下颌骨的位置称牙尖交错位，也称牙位。当牙尖交错（牙合）位于正中时（可称为正中（牙合）时），此位也称为正中（牙合）位。上下牙的牙尖交错位是不稳定的，它会因（牙合）面磨耗，牙齿位置的改变以及牙齿的缺失等，产生适应性的改变。该位置因牙尖交错（牙合）而存在，又称为“牙位”或者最大牙尖交错位。掌握“牙尖交错位、后退接触位与正中关系”知识点。